银汞合金雕刻形态是在充填完成多长时间后开始
A. 1～2分钟
B. 2～3分钟
C. 3～5分钟
D. 6～8分钟
E. 8～10分钟

正确答案：C。3～5分钟

解析：银汞合金充填完成3～5分钟后，即可雕刻形态。掌握“牙体充填材料之银汞合金”知识点。